男，40岁。经常感到时间紧迫，整日忙忙碌碌，工作争强好胜，不甘落后，情绪不稳定，情绪外露，好与人争执，富于敌意。近一年来常出现心前区疼痛，被诊断为冠心病。其人格的行为特征为
A. A型
B. B型
C. C型
D. AC混合型
E. BC混合型

正确答案：A。A型

解析：A型（A对）人格者属于较具进取心、侵略性、自信心、成就感，并且容易紧张。A型人格者总愿意从事高强度的竞争活动，不断驱动自己要在最短的时间里干最多的事，并对阻碍自己努力的其他人或其他事进行攻击，他们在为成就而奋斗的过程中，经常觉得压力很大，精神负担重，神经紧张，交感神经处在兴奋状态下的时间较多，久而久之就会发生高血压、葡萄糖代谢紊乱等情况。加之A型性格的人往往是嗜烟、嗜酒者，也容易发生冠状动脉的收缩，进而易发生冠心病，文中的男子性格好强，又被诊断为冠心病，所以他的人格特征应该为A型行为特征。B型（B错）人格者则属较松散、与世无争，对任何事皆处之泰然。C型（C错）性格指那种情绪受压抑的抑郁性格，表现为害怕竞争，逆来顺受，有气往肚子里咽，爱生闷气的性格。